可引起肺纤维化的药物是
A. 奎尼丁
B. 普鲁卡因胺
C. 利多卡因
D. 胺碘酮
E. 维拉帕米

正确答案：D。胺碘酮